WHO龋病流行程度的评价指标中，等级为中的是
A. 0.0～1.1
B. 1.2～2.6
C. 2.7～4.4
D. 4.5～6.5
E. 6.6以上

正确答案：C。2.7～4.4

解析：WHO龋病流行程度的评价指标（12岁）。掌握“龋病流行病学”知识点。